除了妊娠妇女以外，还有哪类妇女会出现妊娠期龈炎症状
A. 育龄期妇女
B. 长期口服避孕药的妇女
C. 有痛经的妇女
D. 绝经妇女
E. 做过绝育手术的妇女

正确答案：B。长期口服避孕药的妇女

解析：本题考查妊娠期龈炎。妊娠期龈炎指妇女在妊娠期间，由于女性激素（特别是黄体酮）水平升高，原有的牙龈慢性炎症加重，使牙龈肿胀或形成龈瘤样的改变。长期口服避孕药的妇女（B对），体内激素水平发生改变，会使牙龈对局部刺激的反应性增强，慢性炎症加重，出现妊娠期龈炎症状。育龄期妇女（A错）、有痛经的妇女（C错）没有明显的激素水平变化，不会出现妊娠期龈炎症状。绝经妇女（D错）、做过绝育手术的妇女（E错）体内有激素水平的变化，但是女性激素水平降低，也不会出现妊娠期龈炎症状。